左肱骨干上1/3骨折，近折端向前、向内移位，远折端向外、向近端移位。造成这种骨折位移的最主要因素是
A. 肌肉的牵拉力
B. 暴力的大小
C. 搬运固定不当
D. 暴力的性质
E. 肢体的重量

正确答案：A。肌肉的牵拉力

解析：左肱骨干上1/3骨折，近折端受到胸大肌、背阔肌、大圆肌的牵拉而向前、向内移位，远折端因三角肌、喙肱肌、肱二头肌、肱三头肌的牵拉而向外、向近端移位。所以这种移位方式主要由肌肉的牵拉力引起（A对）。暴力的大小（B错）、搬运固定不当（C错）、暴力的性质（D错）、肢体的重量（E错）也会影响骨折移位，但不是引起这种骨折移位的主要因素。